男性，38岁。全身不适，食欲减退2天，伴上唇左侧唇红黏膜及周围皮肤起疱、结痂来诊。在考虑诊断时下列哪种疾病最不可能
A. 疱疹性口炎
B. 唇疱疹
C. 带状疱疹
D. 疱疹性咽峡炎
E. 慢性唇炎

正确答案：E。慢性唇炎

解析：本题考查慢性非特异性唇炎的临床表现。慢性唇炎（E错，为本题正确答案）表现以脱屑为主的慢性脱屑性唇炎或以渗出糜烂为主的慢性糜烂性唇炎，与该患者起疱、结痂的症状不符。疱疹性口炎（A对）也称唇疱疹（B对），由单纯疱疹病毒引起，表现为在口唇或其周围起疱，一般持续24小时，随后破裂，接着是糜烂、结痂。带状疱疹（C对）由水痘-带状疱疹病毒引起，表现为沿单侧神经分布的簇集性小水泡，可融合成大疱，严重者可为血疱或脓疱，也可破溃、结痂。疱疹性咽峡炎（D对）由柯萨奇病毒A4引起，表现似急性疱疹性龈口炎，为丛集成簇的小水疱，不久破溃成溃疡。这几种病都有起疱、结痂的表现，都是可能的诊断，题目要求为最不可能的疾病，因此综上只有慢性唇炎最符合题意。